素体阳虚阴盛者，受邪后多从
A. 寒化
B. 热化
C. 燥化
D. 湿化
E. 传化

正确答案：A。寒化

解析：质化（从化）的一般规律是：素体阴虚阳亢者，功能活动相对亢奋，受邪后多从热化（B错）；素体阳虚阴盛者，功能活动相对不足，受邪后多从寒化（A对）；素体津亏血耗者，易致邪从燥化（C错）；气虚湿盛者，受邪后多从湿化（D错）。